在我国新疆、内蒙古等地一些偏远农村居民的躯干、四肢皮肤发生色素沉着和脱色斑点，伴有周围神经炎症状，患者的手掌和脚跖皮肤过度角化。甚至发展到四肢和躯干，严重者可发展成皮肤癌。调查发现，当地居民饮用的井水中某种化学物质含量过高。该种地方性疾病很可能是
A. 硒中毒
B. 砷中毒
C. 氟中毒
D. 镍中毒
E. 铊中毒

正确答案：B。砷中毒

解析：本题考查地方性砷中毒。地方性砷中毒（B对ACDE错）是由于长期自饮用水、室内煤烟、食物等环境介质中摄入过量的砷而引起的一种生物地球化学性疾病。临床上以末梢神经炎、皮肤色素代谢异常、掌跖部皮肤角化、肢端缺血坏疽、皮肤癌变为主要表现，是一种伴有多系统、多脏器受损的慢性全身性疾病。